给Ⅰ型糖尿病患者皮下注射胰岛素控制血糖的机制属于
A. 改变离子通道的通透性
B. 影响酶的活性
C. 补充体内活性物质
D. 改变细胞周围环境的理化性质
E. 影响机体免疫功能

正确答案：C。补充体内活性物质

解析：本题考查对因治疗。给Ⅰ型糖尿病患者皮下注射胰岛素控制血糖的机制属于补充体内活性物质（C对）。补充疗法是指补充体内营养或代谢物质不足，又称替代疗法。例如，补充铁制剂治疗缺铁性贫血；补充胰岛素治疗糖尿病。改变离子通道的通透性（A错）是钙通道阻滞药硝苯地平降压的机制。影响酶的活性（B错）是有机磷中毒的机制。改变细胞周围环境的理化性质（D错）是抗酸剂等治疗胃溃疡的机制。影响机体免疫功能（E错）是免疫抑制药及免疫调节药的作用机制。